新纹状体是指
A. 尾状核和豆状核
B. 尾状核和苍白球
C. 尾状核和豆状核的壳
D. 苍白球和豆状核的壳
E. 尾状核和杏仁体

正确答案：C。尾状核和豆状核的壳

解析：新纹状体是指尾状核和豆状核的壳（C对）。